用于治疗酒精依赖的药物是
A. 氯氮平
B. 氯丙咪嗪
C. 卡马西平
D. 氟西汀
E. 阿普吗啡

正确答案：E。阿普吗啡

解析：阿普吗啡用于治疗酒精依赖（E对）。氯氮平为第二代抗精神药物（非典型抗精神病药物）（A错）。氯丙咪嗪（氯米帕明）为三环类抗抑郁药（B错）。卡马西平为抗癫痫药物（C错）。氟西汀是抗抑郁药物（D错）。